慢性萎缩性胃炎的胃镜特点
A. 黏膜苍白变薄、可透见黏膜下血管纹
B. 胃黏膜增厚，呈花斑状
C. 黏膜红白相间，可见出血点和糜烂
D. 胃黏膜充血和水肿混杂出现
E. 黏膜多发性糜烂和浅表性溃疡

正确答案：A。黏膜苍白变薄、可透见黏膜下血管纹

解析：慢性萎缩性胃炎的胃镜特点是黏膜苍白变薄、可透见黏膜下血管纹（A对）。胃黏膜增厚，呈花斑状（B错）见于非萎缩性胃炎的胃镜特点。胃黏膜充血和水肿混杂出现（D错）主要见于胆汁、胰液和肠内碱性液体向胃内反流引起的胃镜表现。黏膜红白相间，可见出血点和糜烂（C错）是急性胃炎的胃镜特点，黏膜多发性糜烂和浅表性溃疡（E错）是创伤和物理因素导致的急性胃炎的胃镜特点。